属于上颌骨的支柱结构的是
A. 鼻额支柱
B. 颧突支柱
C. 翼突支柱
D. 尖牙支柱
E. 以上都是

正确答案：E。以上都是

解析：上颌骨的支柱结构：上颌骨与咀嚼功能关系密切，在承受咀嚼压力明显的部位，骨质比较厚，形成三对支柱，均下起上颌骨牙槽突，上达颅底。尖牙支柱（鼻额支柱）、颧突支柱、翼突支柱。掌握“上颌骨解剖特点”知识点。